食品中有害金属污染的毒作用特点
A. 生物半衰期多较长
B. 强蓄积毒性
C. 常以慢性中毒和远期效应为主
D. 生物富集作用
E. 以上全是

正确答案：E。以上全是